右心衰竭时典型的体征是
A. 呼吸困难
B. 咳嗽
C. 咯血
D. 下垂性凹陷性水肿
E. 发绀

正确答案：D。下垂性凹陷性水肿

解析：右心衰竭时典型的体征是下垂性凹陷性水肿（D对）、颈静脉怒张等。呼吸困难（A错）、咳嗽（B错）、咯血（C错）、发绀（E错）均为左心衰竭的症状。